肉眼观察不能确定的坏死是
A. 凝固性坏死
B. 液化性坏死
C. 纤维素样坏死
D. 脂肪坏死
E. 干酪样坏死

正确答案：C。纤维素样坏死

解析：纤维素样坏死是发生在间质、胶原纤维和小血管壁的一种坏死。光镜下，病变部位的组织结构消失，变为境界不甚清晰的颗粒状、小条或小块状无结构物质，呈强嗜酸性，似纤维蛋白，有时纤维蛋白染色呈阳性，肉眼无法观察（C对）。